因抢救急危患者，未能及时书写病历的，有关医务人员应当在抢救结束后据实补记，并加以注明，其时限是
A. 2小时内
B. 4小时内
C. 6小时内
D. 8小时内
E. 12小时内

正确答案：C。6小时内

解析：《医疗事故处理条例》规定，因抢救急危患者，未能及时书写病历的，有关医务人员应当在抢救结束后6个小时内（C对）据实补记，并加以注明。